女，40岁。近4年来逐渐出现活动后心悸气短。查体：心尖部可闻及舒张期隆隆样杂音。最可能的诊断是
A. 二尖瓣狭窄
B. 二尖瓣关闭不全
C. 主动脉瓣狭窄
D. 主动脉瓣关闭不全
E. 肥厚型梗阻性心肌病

正确答案：A。二尖瓣狭窄

解析：患者中年女性，有活动后心悸气短症状，查体：心尖部可闻及舒张期隆隆样杂音（二尖瓣狭窄特征性的杂音），因此最可能的诊断是二尖瓣狭窄（A对）。二尖瓣关闭不全（B错）的典型杂音为心尖区全收缩期吹风样杂音。主动脉瓣狭窄（C错）典型杂音为主动脉瓣区粗糙而响亮的射流性杂音，呈递增-递减型，向颈部传导。主动脉瓣关闭不全（D错）典型杂音为主动脉瓣区舒张早期高调递减型叹气样杂音，向心尖区传导。肥厚型梗阻性心肌病（E错）典型杂音为胸骨左缘第3～4肋间粗糙的喷射性收缩期杂音。